某男，56岁。1年前被确诊为肾结石、慢性肾炎、前列腺增生症。刻下血尿1天，伴腰腹疼痛、排尿不畅。经碎石治疗后，为巩固疗效，又请中医诊治，因工作繁忙无暇煎药，要求服用中成药，医师遂处以排石颗粒，以善其后。依据排石颗粒的使用说明书，药师特别指出应慎用排石颗粒的是
A. 结石嵌顿时间长
B. 排尿不畅
C. 淋沥涩痛
D. 单肾结石
E. 结石直径＜1.5cm

正确答案：A。结石嵌顿时间长

解析：本题考查的是排石颗粒的注意事项。依据排石颗粒的使用说明书，药师特别指出应慎用排石颗粒的是结石嵌顿时间长（A对）。排石颗粒：【主治】下焦湿热所致的石淋，症见腰腹疼痛、排尿不畅（B错）或伴有血尿；泌尿系统结石见上述证候者。【注意事项】孕妇禁用。久病伤正兼见肾阴不足或脾气亏虚等证者慎用。双肾结石（D错）或结石直径≥1.5cm（E错），或结石嵌顿时间长的病例慎用，或根据需要配合其他治疗方法。治疗期间不宜进食辛辣、油腻和煎炸类食物，宜多饮水、配合适量运动。